男性，62岁，持续胸痛4小时。心电图:II、III、aVF导联弓背向上抬高。查体:心率35次/分，心律齐。问心跳过缓的原因
A. 三度房室传导阻滞
B. 右束支传导阻滞
C. 二度一型传导阻滞
D. 房颤
E. 左束支传导阻滞

正确答案：A。三度房室传导阻滞

解析：该患者男，62岁，出现持续胸痛（急性心肌梗死的表现）4小时。心电图:II、III、aVF导联弓背向上抬高（急性下壁心肌梗死的心电图表现）。查体:心率35次/分（三度完全性房室阻滞的表现），心律齐，结合患者的表现和辅助检查，冠心病急性心肌梗死可引起三度房室传导阻滞，故它是出现心跳过缓的原因（A对）。